一项探讨母亲围生期故射暴露与儿童白血病关联的病例对照研究数据如下：200例儿童白血病患者有30例的母亲在孕期接受过放射诊断，400例对照儿童的母亲只有20位在孕期接受过放射诊断。OR值为
A. 1.96
B. 2.74
C. 5.57
D. 2.85
E. 3.35

正确答案：E。3.35